使用血管紧张素转换酶抑制剂降压的患者血清肌酐水平不宜超过
A. 177μmol/L
B. 88μmol/L
C. 133μmol/L
D. 221μmol/L
E. 265μmol/L

正确答案：E。265μmol/L

解析：血肌酐超过3mg/dl（即265μmol/L）患者使用时需谨慎，应定期监测血肌酐及血钾水平。其中血肌酐浓度换算公式为：1mg/dl=88.4μmol/L（ABCD错，E对）。